当归四逆汤的配伍特点是
A. 温中与降逆并施，寓补益于温降之中
B. 温补并用，以温为主
C. 温阳与散寒并用，养血与通脉兼施
D. 温清消补并用，但以温清化瘀为主
E. 温补脾阳与攻下寒积并用

正确答案：C。温阳与散寒并用，养血与通脉兼施

解析：当归四逆汤以桂枝汤去生姜，倍大枣，加当归、通草、细辛组成。方中当归甘温，养血和血；桂枝辛温，温经散寒，温通血脉，为君药。细辛温经散寒，助桂枝温通血脉；白芍养血和营，助当归补益营血，共为臣药。通草通经脉，以畅血行；大枣、甘草，益气健脾养血，共为佐药。重用大枣，既合归、芍以补营血，又防桂枝、细辛燥烈大过，伤及阴血。甘草兼调药性而为使药。本方配伍特点是温阳与散寒并用，养血与通脉兼施，温而不燥，补而不滞（C对）。